肝病患者慎用的药品是
A. 阿米卡星
B. 甲氨蝶呤
C. 泼尼松龙
D. 头孢拉定
E. 硫普罗宁

正确答案：B。甲氨蝶呤

解析：本题考查特殊人群用药。肝病患者慎用甲氨蝶呤（B对）。甲氨蝶呤主要不良反应为胆汁淤积性损害，肝病患者应慎用。阿米卡星（A错）、头孢拉定（D错）具有肾毒性，肾病患者慎用。泼尼松龙（C错）无需经肝脏转化即发挥其生物效应。硫普罗宁（E错）慎用于老年人。